患者左侧T5以下深感觉障碍，右侧T7以下痛温觉消失
A. 左侧T5脊髓损伤
B. 右侧T5脊髓损伤
C. 左侧T7脊髓损伤
D. 右侧T7脊髓损伤
E. 脊髓震荡

正确答案：A。左侧T5脊髓损伤

解析：患者左侧T5以下深感觉障碍，右侧T7以下痛温觉消失，诊断为脊髓半切综合征。即病变节段以下同侧上运动神经元性瘫痪、深感觉障碍、精细触觉障碍及血管舒缩功能障碍，对侧痛温觉障碍（A对BCD错）。脊髓震荡是指，脊髓在外力或者损伤后，立刻出现的一种短暂的，可逆的神经功能的异常（E错）。